病例对照研究方法最大的优点是
A. 设立对照
B. 属于观察法
C. 可研究一种疾病与多种因素的关系
D. 随机分组
E. 偏倚小

正确答案：C。可研究一种疾病与多种因素的关系